有关应激的生理反应说法错误的是
A. 激素水平升高
B. 引发病理性改变
C. 降低心的血流供应
D. 广泛影响体内各系统的功能
E. 持续的应激引起机体生理功能的紊乱

正确答案：C。降低心的血流供应

解析：应激源作用于人体时，中枢神经系统对应激信息接受、整合，传递至下丘脑，下丘脑通过交感－肾上腺髓质系统，释放大量儿茶酚胺，增加心、脑、骨骼肌的血流供应。同时，下丘脑分泌的神经激素可兴奋垂体－肾上腺皮质系统，导致激素水平升高，广泛影响体内各系统的功能。严重而持续的应激可引起机体生理功能的紊乱和失衡，以至于引发病理性改变。掌握“心理应激”知识点。